下列哪项不是增加抗力的措施
A. 去除无机釉
B. 去除薄壁弱尖
C. 保留承力区的薄壁弱尖
D. 洞缘线设计为圆钝曲线
E. 做盒形洞形

正确答案：C。保留承力区的薄壁弱尖

解析：本题考查增加抗力的措施。保留承力区的薄壁弱尖（C错，为本题的正确答案）不是增加抗力的措施。无基釉缺乏牙本质支持，在承受咬合力时易折裂，去除无基釉可增加牙齿的抗力（A对）。薄壁弱尖是牙齿的脆弱部分，备洞时应去除薄壁弱尖（B对），若保留承力区的薄壁弱尖，在承受咬合力时易导致牙体组织折裂。洞缘线设计为圆钝曲线可分散应力（D对）。盒形洞形是最基本的抗力形，可使咬合力均匀分布，避免产生应力集中（E对）。